在金属嵌体修复的牙体预备中，下列说法正确的是
A. 预备的洞形应有倒凹
B. 预备的洞形的所有轴壁应内聚2°～5°
C. 洞缘应有斜面
D. 洞缘应无斜面
E. 不可作预防性扩展

正确答案：C。洞缘应有斜面

解析：洞缘有斜面：一般在洞缘牙釉质内预备出45°斜面，斜面宽度约0.5～1.0mm，并可根据情况对斜面深度和角度作适当调整。斜面预备的目的是：①去除洞缘无基釉，预防釉质折断。②增加嵌体的洞缘密合性与封闭作用，防止粘固剂被唾液溶解，减少微漏的发生。但洞缘斜面不能过大，否则会降低轴壁深度，影响固位力。斜面一般起于釉质层的1/2处。掌握“金属嵌体”知识点。